毒物是指
A. 对大鼠经口LD₅₀＞500mg/kg体重的物质
B. 凡引起机体功能或器质性损害的物质
C. 具有致癌作用的物质
D. 在一定条件下，较小剂量即能对机体发生损害作用的物质

正确答案：D。在一定条件下，较小剂量即能对机体发生损害作用的物质

解析：本题考查毒物。毒物是指在一定的条件下，较低的剂量时即可导致机体损害的物质（D对ABC错）。